不出现管型尿的疾病是
A. 肾病综合征
B. 急性肾小球肾炎
C. 急进性肾小球肾炎
D. 急性肾盂肾炎
E. 急性膀胱炎

正确答案：E。急性膀胱炎

解析：管型尿出现表示尿中蛋白质或细胞成分在肾小管内凝固、聚集，其形成与蛋白质的性质和浓度、尿液酸碱度以及尿量有密切关系。急性膀胱炎的病理变化主要表现为膀胱黏膜血管扩张、充血、上皮细胞肿胀、黏膜下组织充血、水肿及炎细胞浸润，肾小球或肾小管一般不受累（E错，为本题正确答案）。肾病综合征关键性的改变是肾小球毛细血管壁的损伤，血浆蛋白滤过增加，可形成大量蛋白管型（A对），急性肾小球肾炎病变累及肾小球，出现蛋白管型、红细胞或白细胞管型及颗粒管型（B对）。急进性肾小球肾炎病请进展急骤早期可出现少尿无尿进行性肾功衰，出现红细胞管型（C对）。急性肾盂肾炎病变累及肾小管出现管型尿（D对）。